易引起肺水肿的病因是
A. 肺心病
B. 肺梗塞
C. 肺气肿
D. 二尖瓣狭窄
E. 三尖瓣狭窄

正确答案：D。二尖瓣狭窄

解析：二尖瓣狭窄（D对）时左心房压力增高，引起肺循环淤血肺毛细血管静脉压上升，肺毛细血管血管壁渗透性增高，从而出现肺水肿。肺心病（A错）、肺梗塞（B错）、肺气肿（C错）及三尖瓣狭窄（E错）时一般不出现肺水肿。